男性，70岁。间断上腹痛20余年，2月来加重伴饱胀，体重下降至60kg，Hb90g/L，最可能的诊断是
A. 慢性胆囊炎
B. 慢性肝炎
C. 胃癌
D. 消化性溃疡
E. 功能性消化不良

正确答案：C。胃癌

解析：老年男性患者，间断上腹痛20余年，2月来加重伴饱胀（症状明显改变，提示病情进展），体重下降至60kg，Hb90g/L（正常男性为120～160g/L，提示贫血），结合患者病史和相关检查，最可能的诊断为胃癌（C对）。胃癌常见于中老年男性患者，早期多无明显症状，随病情进展，病人可出现上腹痛，食欲下降、乏力、消瘦、体重减轻等表现，纤维胃镜检查可以确诊。慢性胆囊炎（P445）（A错）的患者多有胆绞痛病史，常表现为饱食、进食油腻食物后出现腹胀、腹痛，疼痛可放射至右肩背部，一般无体重减轻及贫血等表现。慢性肝炎（B错）指由不同病因引起的，病程至少持续6个月的肝脏坏死和炎症，患者多有肝掌、蜘蛛痣、黄疸等肝功能减退的表现。消化性溃疡（D错）常表现为节律性、周期性和与季节相关的上腹疼痛，腹痛可被抑酸或抗酸药物缓解，其癌变的几率较低。功能性消化不良（九版内科学P384）（E错）指由胃和十二指肠功能紊乱引起的，而无器质性病变的一组临床综合征，起病多缓慢，主要表现为餐后饱胀、早饱感、上腹胀痛、嗳气、食欲不振、恶心等，呈持续性或反复发作，患者多有饮食、精神等诱发因素，一般无体重减轻及贫血等。